粘糠酸是哪种毒物的代谢产物
A. 苯胺
B. 三硝基甲苯
C. 苯
D. 甲苯

正确答案：C。苯

解析：本题考查粘糠酸的形成。酚类代谢产物可与硫酸盐或葡萄糖醛酸结合后自肾脏排出，故接触苯（C对ABD错）后，尿酚排出量增加。有时候中间产物可快速氧化生成反-反式粘糠酸，最后氧化成二氧化碳而被呼出。具体的流程可参考职业卫生与职业医学第八版136页图 3-2的过程。